呼吸急促似喘，喉间有哮鸣音者，称为
A. 喘
B. 哮
C. 短气
D. 上气
E. 独语

正确答案：B。哮

解析：哮证常表现为呼吸急促似喘，喉间有哮鸣音，并且反复发作，缠绵难愈（B对）。喘证常表现为呼吸困难、短促急迫，甚至张口抬肩，鼻翼煽动，难以平卧（A错）。短气指呼吸气急短促，气短不足以息，数而不相接续，似喘而不抬肩，喉中无痰鸣音（C错）。上气指肺气上逆，即咳嗽，常表现为有气上升至喉咙，声道关闭，突然开放发出的一种“咳、咳”的声音（D错）。独语常表现为自言自语，喃喃不休，见人语止，首尾不续者（E错）。